外疡五善中肾善的表现为
A. 口和齿润
B. 舌润不渴
C. 指甲红润
D. 唇色滋润
E. 皮肤润泽

正确答案：A。口和齿润

解析：五善：“善”是好的征象。在病程中出现善的症状，表示预后较好。“五善”包括心善、肝善、脾善、肺善、肾善。肾善为身无潮热，口和齿润，小便清长，夜卧安静（A对）；心善为精神爽快，言语清亮，舌润不渴（B错），寝寐安宁；肝善为身体轻便，不怒不惊，指甲红润（C错），二便通利；脾善为唇色滋润（D错），饮食知味，脓黄而稠，大便和润；肺善为声音响亮，不咳不喘，呼吸均匀，皮肤润泽（E错）。